在符号中，各字母的含义是：D
A. 旋光度
B. 折光率
C. 温度
D. 密度
E. 光源

正确答案：E。光源